致密性骨炎X线表现为
A. 呈现为境界明显的密度减低区，有时表现为多房性骨吸收
B. 颌骨膨胀病变部位边缘模糊，不整齐，下颌骨可形成囊肿样腔洞
C. 虫蚀状骨吸收，有局灶性阻射影，伴有骨新生时，则有骨硬化的表现
D. 圆形界限清楚的阻射区，局限于一个或两个牙的根尖区，与牙根容易区分
E. 病变骨区阻射性降低，呈磨玻璃样改变，病变与周围正常骨的界限不明显

正确答案：D。圆形界限清楚的阻射区，局限于一个或两个牙的根尖区，与牙根容易区分

解析：本题考查结核性骨髓炎及放射性骨髓炎。慢性局灶性硬化性骨髓炎又称为致密性骨炎，是轻度感染导致骨的局灶性反应，多与慢性根尖周炎有关。一般无症状，多在常规X线检查中偶然发现。多发生于下颌第一磨牙的根尖区，少数见于下颌第二磨牙或前磨牙的根尖区。X线表现为圆形界限清楚的阻射区，局限于一个或两个牙的根尖区，与牙根容易区分（D对），这点可以与其他牙骨质增生性疾病相鉴别。